长期抗炎治疗哮喘的最常用的方法
A. 吸入肾上腺素
B. 吸入麻黄碱
C. 吸入异丙托溴铵
D. 吸入糖皮质激素
E. 吸入色甘酸钠

正确答案：D。吸入糖皮质激素

解析：糖皮质激素是目前控制哮喘最有效的药物。激素通过作用于气道炎症形成过程中的诸多环节，如抑制嗜酸粒细胞等炎症细胞在气道的聚集、抑制炎症介质的生成和释放、增强平滑肌细胞β₂肾上腺素受体的反应性等，有效抑制气道炎症，吸入糖皮质激素（D对）是长期抗炎治疗哮喘的最常用的方法，其局部抗炎作用强、全身不良反应少。吸入肾上腺素（A错）、吸入麻黄碱（B错）的药理作用是舒张支气管、缓解哮喘症状，不是抗炎，且不宜长期使用。吸入异丙托溴铵为短效抗胆碱药，通过迷走神经通路，降低迷走神经张力而起到舒张支气管、减少分泌的作用，主要用于治疗哮喘急性发作，不是抗炎药物，且不宜长期使用。吸入色甘酸钠是抗IgE抗体，具有降低气道高反应性的作用，可以长期应用，但不能抗炎（E错）。